以下各项可能是丝状乳头萎缩的原因，除了
A. 贫血
B. 舔舌习惯
C. 维生素B缺乏
D. 真菌感染
E. 地图舌

正确答案：B。舔舌习惯

解析：本题考查丝状乳头萎缩的原因。丝状乳头萎缩的原因，除了舔舌习惯（B错，为本题的正确答案）。舔舌习惯一般不造成丝状乳头萎缩。丝状乳头炎以萎缩性损害为主，全身因素多见，包括营养不良、贫血（A对）、血液性疾病、真菌感染（D对）、滥用抗生素、内分泌失调、维生素缺乏（C对）等。地图舌病因不明，中央区表现为丝状舌乳头萎缩微凹（E对）。